个体为维持自己生存和种族延续适应不断变化的复杂环境所作出的各种反应称为
A. 应激
B. 学习
C. 行为
D. 动机
E. 需要

正确答案：A。应激